关于女性内生殖器解剖正确的是
A. 子宫峡部非孕期长约2cm
B. 子宫内膜各层均发生周期性变化
C. 子宫韧带共有3对
D. 阴道穹隆四部中前穹隆最深
E. 站立时直肠子宫陷凹为女性腹膜腔最低位置

正确答案：E。站立时直肠子宫陷凹为女性腹膜腔最低位置

解析：女性内生殖器位于真骨盆内，包括阴道、子宫、输卵管和卵巢。阴道穹隆是子宫颈与阴道间的圆周状隐窝，其中后穹隆最深（D错），而与之相邻的直肠子宫陷凹是站立时腹腔最低部位（E对）。子宫峡部是子宫体与子宫颈之间形成的最狭窄部分，非孕时长约1cm（A错），妊娠后逐渐伸展变长，临产后伸展至7～10cm，成为产道的一部分，是产科手术学的重要解剖结构。子宫内膜分为致密层、海绵层和基底层3层，其中致密层和海绵层（统称为功能层），受卵巢性激素影响，发生周期性变化而脱落，基底层不受卵巢性激素影响，不发生周期变化（B错）。子宫韧带共有4对（C错），包括：圆韧带、阔韧带、主韧带和宫骶韧带。